世界卫生组织规定的青春期年龄为
A. 8～18岁
B. 10～20岁
C. 10～19岁
D. 12～20岁
E. 12～22岁

正确答案：C。10～19岁

解析：本题考查青春期的年龄范围。1986年联合国世界卫生组织（WHO）将青春期年龄范围定在10～19岁（C对ABDE错），此年龄范围目前已被广泛采用。女孩的青春期一般在10～11岁开始，比男孩早1～2年，大约在17～18岁结束。WHO还提出了青少年的年龄范围为10～24岁，青年期的年龄范围为15～24岁。